呕吐肠鸣下利，心下痞满不痛，最适宜用的方剂是
A. 大柴胡汤
B. 十枣汤
C. 半夏泻心汤
D. 生姜泻心汤
E. 甘草泻心汤

正确答案：D。生姜泻心汤

解析：伤寒表证，通过发汗治疗，其表虽解，但“胃中不和”，究其原因，或因患者素体脾胃气弱，或是汗不如法损伤脾胃之气，以致邪气乘机内陷，寒热错杂于中，气机痞塞不通，脾胃升降失常，形成痞证。一般而言，心下痞应但满而不痛，按之柔软，此言“心下病硬”，是谓按之心下有紧张感，说明本证除无形之气据塞之外，还夹杂有水饮、食滞的有形之邪。然虽心下痞硬，却按之不痛。故仍属痞证而非结胸之证。“胁下有水气”，既言病机，提示本证有水饮内停中焦；又言症状，即胃脘两侧之胁下有水气相搏之辘辘作响。脾虚不运，胃气上逆，水食停滞于胃，故干噫食臭；水气流于胁下，或走于肠间，则肠鸣下利。治以生姜泻心汤和胃降逆，散水清痞（D对）。